因含黏液质较多，需包煎的中药饮片是
A. 车前子
B. 石决明
C. 琥珀粉
D. 决明子
E. 滑石粉

正确答案：A。车前子

解析：本题考查的是车前子的煎服方法。因含黏液质较多，需包煎的中药饮片是车前子（A对）。包煎：包煎即是把需包煎的饮片装在用棉纱制成的布袋中，扎紧袋口后与群药共同煎煮。需要包煎的药物主要有以下几类。（1）含黏液质较多的饮片，包煎后可避免在煎煮过程中黏煳锅底。如车前子、葶苈子等。（2）富含绒毛的饮片，包煎后可避免脱落的绒毛混入煎液后刺激咽喉引起咳嗽。如旋覆花、枇杷叶等。（3）花粉等微小饮片，因总表面积大，疏水性强，故也宜包煎，以免因其漂浮而影响有效成分的煎出。如蒲黄、海金沙、蛤粉、六一散等。石决明（B错）【内服特殊煎法和特殊用法】先煎。冲服：贵细中药用量少，宜先研成粉末再用群药的煎液冲服，避免因与他药同煎而导致其成分被药渣吸附而影响药效。如雷丸、蕲蛇、羚羊角、三七、川贝、琥珀（C错）、鹿茸、紫河车、沉香、金钱白花蛇等。决明子（D错）【特殊调剂】用时捣碎。滑石粉（E错）【特殊调剂】包煎。